大黄附子汤的主治证候是
A. 大便稀溏
B. 腰膝酸软
C. 小便频数
D. 久痢赤白
E. 手足厥逆

正确答案：E。手足厥逆

解析：大黄附子汤以附子温里助阳，散寒止痛，以大黄通导大便，荡涤肠道积滞，佐以细辛，辛温宣通，既散在经之寒，又助附子温里散寒，三药并用，共奏温里散寒，攻下寒积之效，主治畏寒肢冷，腹痛便秘，手足不温（E对），苔白腻，脉弦紧的寒积里实证，为温下之基础方。